残髓炎也属于
A. 急性牙髓炎
B. 慢性牙髓炎
C. 牙髓-牙周联合病变
D. 牙釉质发育异常
E. 牙本质发育异常

正确答案：B。慢性牙髓炎

解析：残髓炎也属于慢性牙髓炎。掌握“残髓炎及逆行性牙髓炎”知识点。